《中华人民共和国消费者权益保护法》规定，消费者在购买、使用商品或接受服务时
A. 享有财产不受损害的权利
B. 享有人身安全不受损害的权利
C. 享有人体健康不受损害的权利
D. 享有卫生条件不受影响的权利
E. 享有人身、财产安全不受损害的权利

正确答案：E。享有人身、财产安全不受损害的权利

解析：本题考查安全保障权。《中华人民共和国消费者权益保护法》规定，消费者在购买、使用商品或接受服务时享有人身、财产安全不受损害的权利（E对）。消费者有权要求经营者提供的商品和服务，符合保障人身、财产安全的要求。